持续腹痛血便，肠鸣音消失，有腹膜刺激征的原因是
A. 麻痹性肠梗阻
B. 低位肠梗阻
C. 痉挛性肠梗阻
D. 绞窄性肠梗阻
E. 高位肠梗阻

正确答案：D。绞窄性肠梗阻

解析：持续性腹痛血便，肠鸣音消失，有腹膜刺激征，其原因应该为绞窄性肠梗阻（D对）。绞窄性肠梗阻为伴有相应肠段血运障碍的肠梗阻，可继发肠坏死或穿孔，因为存在持续性的血运障碍，因此腹痛呈持续性，肠壁血运障碍，使毛细血管通透性增加，肠壁水肿并有大量液体渗出至肠腔及腹腔，因此可相应出现血便、腹膜刺激征阳性，此时由于肠鸣音可因肠坏死和腹膜炎消失。麻痹性肠梗阻（A错）腹胀较显著，因为其肠壁肌呈瘫痪状态因此无收缩即无阵发性腹痛，只有持续性胀痛或不适，肠鸣音可减弱或消失。低位肠梗阻（B错）的腹胀症状也较显著，呕吐发生较晚但呕吐物常为粪样内容物。高位肠梗阻（E错）较显著的特点是呕吐发生较早、较频繁，呕吐物常为胃及十二指肠内容物。痉挛性肠梗阻（C错）相对比较少见，可发生于急性肠炎、慢性铅中毒或肠功能紊乱的病人。